某男性工人，接尘工龄26年，主诉轻度运动后即感呼吸困难，体温正常，无明显咳痰，诊断一期石棉肺。石棉肺的基本病理变化是
A. 石棉结节形成
B. 石棉小体
C. 弥漫性间质纤维化
D. 胸膜斑
E. 胸膜粘连

正确答案：C。弥漫性间质纤维化

解析：本题考查石棉肺的基本病理变化。石棉肺是在生产过程中长期吸入石棉粉尘所引起的以肺组织弥漫性纤维化（C对ABDE错）为主的疾病。其特点是全肺弥漫性纤维化，是弥漫性纤维化型尘肺的典型代表，不出现或极少出现结节性损害。石棉肺的病变特点是肺间质弥漫性纤维化，石棉小体形成及脏层胸膜肥厚，壁层胸膜形成胸膜斑。